检索文献时，通过文章后面所列的参考文献进一步查找其他相关文章，可带来
A. 引用偏倚
B. 发表偏倚
C. 文献检索偏倚
D. 多次发表偏倚
E. 有偏倚的人选标准

正确答案：A。引用偏倚

解析：本题考查引用偏倚。手工检索文献时，通过文章后面所列的参考文献可以进一步查找其他相关文章。但在meta分析中这种途径可能带来引用偏倚（A对BCDE错），因为支持阳性结果的试验比不支持的试验可能更多地被作为参考文献加以引用。